不属于药事管理活动的是
A. 制定药品储备计划
B. 医疗保险定点药店管理
C. 医药企业工商登记管理
D. 药品配送管理
E. 政府制定药品价格

正确答案：C。医药企业工商登记管理